筛检的目的是
A. 对可疑病人进行确诊
B. 评价筛检试验的敏感度
C. 验证病因
D. 评价筛检试验的特异度
E. 从表面健康的人群中查出某病的可疑患者或某病的高危人群

正确答案：E。从表面健康的人群中查出某病的可疑患者或某病的高危人群

解析：筛检是运用快速、简便的检验、检查或其他措施，在健康的人群中，发现那些表面健康但可疑有病或某病的高危人群，识别疾病的早期阶段，合理分配卫生资源（E对C错）。筛检试验仅是一个初步的检查，对筛检结果阳性或可疑阳性者需进一步做确诊检查（A错）。敏感度（B错）、特异度（D错）、假阳性率是评价试验真实性的指标。